绞窄性肠梗阻的临床表现，哪项是错误的
A. 持续剧痛无缓解
B. 呕吐血性或棕褐色液体
C. X线示膨胀突出的孤立肠袢随时间改变位置
D. 出现腹膜刺激征
E. 肠鸣音消失

正确答案：C。X线示膨胀突出的孤立肠袢随时间改变位置

解析：绞窄性肠梗阻发病急，持续性剧烈腹痛，无缓解（A对），呕吐出现早而频繁，呕吐物、胃肠减压抽出液、肛门排出物为血性，腹腔穿刺抽出血性液体（B对），有压痛，反跳痛，肌紧张等（D对）腹膜炎的体征，有时可叩出移动性浊音，腹壁有压痛，肠鸣音微弱或消失（E对），体温上升、脉率增快、白细胞计数增高等，X线可见可见孤立、位置及形态不变的肠袢，腹部局限性密度增加等（C错，为本题正确答案）。